不符合精神检查原则的是
A. 先问一般性问题，后问实质性问题
B. 针对患者的自述症状，应与其认真讨论并当面纠正
C. 先提开放式的问题，后提封闭式问题
D. 建立好良好的医患关系
E. 在交谈过程中需注意非语性交流

正确答案：B。针对患者的自述症状，应与其认真讨论并当面纠正

解析：在精神检查时，首先建立良好的医患关系（D对）是精神科后续诊断和治疗的前提，和谐的医患关系有利于患者病情的好转；其次在医生与患者面谈的过程中，需要一个不受干扰的环境和医患之间的自我介绍和称谓（以使患者达到放松的状态），在医生与患者的一般性接触后，再逐步转入对实质性的内容的交谈（A对）。交谈时应注意：1.先提开放式的问题，后提封闭式问题（C对），且以开放性交谈为主（开放性交谈可以启发患者谈出自己的内心体验，有助于对患病情况的了解）；2.主导谈话：使话题能集中在相关问题上，不要纠结于患者的自述症状等细枝末节，避免混淆头绪，如有必要，医生可以打断患者的谈话，直接询问关键性问题（B错，为本题的正确答案）；3.在交谈过程中需注意非言语性交流（E对），可以用这种手段鼓励或制止患者的谈话，有时适当的身体接触也有助于缓解患者的紧张情绪。